医生在询问病史时应遵循的道德要求是
A. 举止热情、态度亲如兄弟
B. 全神贯注、语言得当
C. 医生在询问病史过程中，不能发出惊叹、惋惜等语言
D. 主导谈话，引导患者说出自已想听的内容
E. 反复提问，尽量使用专业性术语

正确答案：B。全神贯注、语言得当